女性，45岁，胆囊结石5年，曾胆绞痛发作3次，B超示胆囊结石5枚，直径1～2cm，首选的治疗方法是
A. 胆囊切除
B. 溶石治疗
C. 体外震波碎石治疗
D. 抗感染治疗
E. 排石治疗

正确答案：A。胆囊切除

解析：患者胆囊结石数量多，直径较大，故首选胆囊切除（A对）。直径大于15mm的结石，溶石治疗（B错）效果差。对于单个较大的结石，体外震波碎石治疗（C错）治疗效果好，对于多个较大结石容易形成石街，不易根除，易复发。抗感染治疗（D错）为胆囊结石的一般治疗措施，对结石引起的细菌性感染有预防和治疗作用，不解决根本问题。排石治疗（E错）一般适用于直径在3mm以下的胆囊结石，患者结石直径为1～2cm，排石治疗。